具有利湿退黄，解毒消肿功效的药物是
A. 茵陈
B. 萆薢
C. 虎杖
D. 地肤子
E. 金钱草

正确答案：E。金钱草

解析：该题考查金钱草的功效。金钱草味甘、咸，性微寒，入肝、胆、肾、膀胱经，其功效为利湿退黄，利尿通淋，解毒消肿（E对）。